患者，女，27岁。孕36周，面浮肢肿，皮薄光亮，按之凹陷，脘腹胀满，气短懒言，食欲不振，小便短少，舌淡胖，边有齿痕，苔薄白，脉缓滑无力。治疗应首选的方剂是
A. 千金鲤鱼汤
B. 白术散
C. 五苓散
D. 真武汤
E. 天仙藤散

正确答案：B。白术散

解析：患者孕36周，面浮肢肿，皮薄光亮，按之凹陷，脘腹胀满，舌淡胖，边有齿痕，是由于脾虚运化失职，可致水湿停聚，加之胎儿长大，阻碍气机，不能敷布津液、水湿，泛溢肌肤则为水肿。气短懒言，食欲不振，小便短少，是由气虚导致，则选方白术散（B对）。千金鲤鱼汤治疗以妊娠水肿，下肢肿胀为据（A错）。五苓散主治膀胱蓄水证（C错）。真武汤主治肾阳虚衰兼水湿泛溢之证（D错）。天仙藤散主治 妊娠浮肿（E错）。